不属于体内甘油脂类正常生理功能的是
A. 保持体温
B. 传递电子
C. 参与维生素吸收
D. 构成生物膜
E. 参与信息传递

正确答案：B。传递电子

解析：体内甘油脂类正常的生理功能主要包括提供能量，维持体温（A对），构成细胞膜（D对），提供必需脂肪酸，促进脂溶性维生素的吸收（C对）及参与信息传递（E对）等。甘油脂类不具有传递电子（B错，为本题正确答案）作用。